下列选项中是生命质量测量中最敏感的是
A. 体力适度性
B. 身体状况
C. 认知功能
D. 社会接触
E. 情绪反应

正确答案：E。情绪反应

解析：本题考查生命质量测量中最敏感的部分。情绪反应（E对ABCD错）是生命质量测量中最敏感的部分，不仅直接受疾病和治疗措施的影响，病人的生理状态和社会功能状态的变化，也会间接地从情绪反应中表现出来。